下列哪项不是引起呼吸性碱中毒合并代谢性碱中毒的原因？
A. 水杨酸中毒
B. 高热合并呕吐
C. 肝功能衰竭患者使用髓袢利尿剂
D. 严重创伤患者伴呕吐
E. 败血症患者伴呕吐

正确答案：A。水杨酸中毒

解析：呼吸性碱中毒合并代谢性碱中毒常见原因为通气过度导致呼吸性碱中毒，又因呕吐使大量胃液丢失或利尿剂应用不当而出现代谢性碱中毒，高热、肝功能衰竭、严重创伤、败血症等都能刺激呼吸中枢而发生通气过度，所以高热合并呕吐（B对）、肝功能衰竭患者使用髓袢利尿剂（C对）、严重创伤患者伴呕吐（D对）、败血症患者伴呕吐（E对）都会导致呼吸性碱中毒合并代谢性碱中毒。水杨酸中毒（A错，为本题正确答案）时由于酸性物质增加引起代谢性酸中毒，又因为水杨酸盐刺激呼吸中枢导致呼吸性碱中毒。